饮茶可减少其吸收的药物是
A. 阿仑膦酸钠
B. 去氨加压素
C. 硫酸亚铁
D. 阿莫西林
E. 辛伐他汀

正确答案：C。硫酸亚铁

解析：本题考查饮食对药物疗效的影响。硫酸亚铁（C对）中的铁离子可与茶叶中鞣酸结合发生沉淀，影响药品吸收。阿仑膦酸钠（A错）、去氨加压素（B错）、阿莫西林（D错）、辛伐他汀（E错）不易于鞣酸结合，与茶叶同服不会减少吸收。